女，40岁，右上颌第一磨（牙合）面纵向隐裂且累及牙髓，临床牙冠较短，咬合紧，根管治疗已完成。该病例的最适修复体设计是
A. 锤造全冠
B. 铸造全冠
C. 邻（牙合）嵌体
D. 瓷全冠
E. 嵌体

正确答案：B。铸造全冠

解析：本题考查铸造金属全冠的适应证。此患者是磨牙纵向隐裂累及牙髓，所以需要制作全冠保护此牙以免隐裂造成牙体折断。铸造全冠（B对）既可以保护隐裂磨牙，又可以耐受较大的咬合压力。锤造全冠（A错）现被铸造全冠取代。患牙经过根管治疗后易折断，邻（牙合）嵌体（C错）、嵌体（E错）不能全面包裹患牙牙冠，不如金属全冠能更好保护患牙。瓷全冠（D错）需要足够的牙体预备量，但此患者牙冠较短，咬合紧，无法获得足够的牙体预备量，不适合此患者。